下列哪项不是诊断Ⅱ度慢性放射病的条件
A. 长期射线接触史
B. 乏力、头痛、头晕等自觉症状
C. 有明显出血倾向
D. 白细胞在稳定减少在3.0✕10⁹/L以下，骨髓增生活跃
E. 治疗后恢复缓慢

正确答案：D。白细胞在稳定减少在3.0✕10⁹/L以下，骨髓增生活跃